治疗淋病首选的药物是
A. 青霉素
B. 多西环素
C. 四环素
D. 头孢曲松
E. 红霉素

正确答案：D。头孢曲松

解析：淋病由淋病奈瑟菌（革兰阴性双球菌）感染引起，治疗淋病的首选药物是头孢曲松（D对）。青霉素（A错）是梅毒的首选治疗药物；多西环素（B错）为广谱抑菌剂，但对革兰阳性菌作用优于革兰阴性菌；四环素（C错）对革兰氏阳性菌、立克次体、滤过性病毒、螺旋体属乃至原虫类都有很好的抑制作用；红霉素（E错）对革兰阳性菌有较强的抑制作用。